根据现行法律法规和相关部委的主要职责，组织制定国家药物政策和国家基本药物制度，提出国家基本药物价格政策的建议的是
A. 市场监督管理部门
B. 卫生健康管理部门
C. 医疗保障主管部门
D. 中医药管理部门

正确答案：B。卫生健康管理部门

解析：本题考查药品管理工作相关部门职责。卫生健康管理主管部门（B对）负责组织制定国家药物政策和国家基本药物制度，开展药品使用监测、临床综合评价和短缺药品预警，提出国家基本药物价格政策的建议，制定医疗机构、医疗服务行业管理办法并监督实施，建立医疗服务评价和监督管理体系等。市场监督管理部门（A错）负责相关市场主体登记注册和营业执照核发，查处准入、生产、经营、交易中的有关违法行为，实施反垄断执法、价格监督检查和反不正当竞争，负责药品、保健食品、医疗器械、特殊医学用途配方食品广告审查和监督处罚。医疗保障主管部门（C错）负责拟订医疗保险、生育保险、医疗救助等医疗保障制度的法律法规草案、政策、规划和标准，制定部门规章并组织实施。中医药管理部门（D错）负责拟订中医药和民族医药事业发展的战略、规划、政策和相关标准，起草有关法律法规和部门规章草案，参与国家重大中医药项目的规划和组织实施。